哪项不正确
A. 锥体系以外的躯体运动传导路
B. 精细随意运动的发动
C. 种系发生上的比较古老的系统
D. 调节肌张力
E. 维持调节体态姿势

正确答案：B。精细随意运动的发动

解析：锥体外系是锥体系以外的躯体运动传导路（A对），种系发生上的比较古老（C对），主要功能是调节肌张力（D对），维持体态姿势（E对）,锥体系才能完成一切精确的随意运动（B错，为本题正确选项）。